血小板数升高是指
A. 血小板数高于80×10⁹/L
B. 血小板数高于100×10⁹/L
C. 血小板数高于200×10⁹/L
D. 血小板数高于300×10⁹/L
E. 血小板数高于400×10⁹/L

正确答案：E。血小板数高于400×10⁹/L

解析：血小板正常值为（100～300）×10⁹/L，低于100×10⁹/L为血小板减少，高于400×10⁹/L（E对）为血小板增多。